按分散系统分类，属于非均相液体制剂的有
A. 低分子溶液剂
B. 混悬剂
C. 乳剂
D. 高分子溶液剂
E. 溶胶剂

正确答案：B、C、E。混悬剂；乳剂；溶胶剂

解析：本题考查非均相液体制剂。非均相液体制剂包括混悬剂（B对）、乳剂（C对）、溶胶剂（E对）；低分子溶液剂（A错）、高分子溶液剂（D错）为均相液体制剂。